在下列氨基酸中属于碱性氨基酸是
A. 丝氨酸
B. 赖氨酸
C. 谷氨酸
D. 酪氨酸
E. 苏氨酸

正确答案：B。赖氨酸

解析：赖氨酸属于碱性氨基酸。掌握“氨基酸与多肽及蛋白质结构”知识点。